治疗鹅口疮心脾积热证，应首选
A. 清热泻脾散
B. 参苓白术散
C. 泻心导赤散
D. 黄连解毒汤
E. 六味地黄丸

正确答案：A。清热泻脾散

解析：鹅口疮心脾积热证是由于秽毒积热蕴于心脾，熏灼口舌而致，故治疗时应清心泻脾，首选清热泻脾（A对）。参苓白术散（B错）其功用为益气健脾，渗湿止泻，适应于脾虚泻。泻心导赤散（C错）其功用为清心泻火，适用于疱疹性口炎之心火上炎证。黄连解毒汤（D错）其功用为泻火解毒，适用于三焦火毒证。六味地黄丸（E错）加肉桂，共起滋阴降火，引火归元的作用，适应于疱疹性口炎虚火上浮证